牙源性角化囊肿多发生于
A. 以下颌第三磨牙区多见，其次为上颌单尖牙，上颌第三磨牙和下颌前牙区者
B. 位于上颌恒侧切牙和单尖牙之间，呈倒置的梨形，相邻牙齿为活髓牙者
C. 下颌磨牙及升支部
D. 颈上部，下颌角附近，胸锁乳突肌上1/3前缘者
E. 腭中线前部者

正确答案：C。下颌磨牙及升支部

解析：2005年的WHO头颈部肿瘤分类中已将牙源性角化囊肿命名为牙源性角化囊性瘤，是一种良性、单囊或多囊、发生于颌骨内的牙源性肿瘤。临床上，牙源性角化囊肿患者的年龄分布较广，但好发在10～29岁之间。男性较女性多见，病变多累及下颌磨牙及升支部。掌握“牙源性角化囊性瘤”知识点。